对发生医疗事故的赔偿等民事责任争议问题处理时，可以考虑的方式是
A. 医疗事故损害后果与患者原有疾病状况之间的关系
B. 患者的经济状况
C. 患者亲友在纠纷处理过程中的态度
D. 无过错输血感染造成的不良后果
E. 医患双方协商解决

正确答案：E。医患双方协商解决

解析：发生医疗事故的赔偿等民事责任争议，医患双方可以协商解决（E对）；不愿协商或协商不成的，当事人可以向卫生行政部门提出调查申请，也可以直接向人民法院提起民事诉讼。